能表示药材品质的药名是
A. 炒山药
B. 煨木香
C. 焦山楂
D. 苦杏仁
E. 明天麻

正确答案：E。明天麻

解析：本题考查的是与药名有关的术语。能表示药材品质的药名是明天麻（E对）。与药名有关的术语：1.炮制类：采用不同的方法炮制中药，可获得不同的作用和疗效。医师根据医疗需要，提出不同的炮制要求。如酒蒸大黄，能缓和其泻下作用；蜜炙麻黄，能缓和其辛散之性，增强其止咳平喘功效；炒山药（A错），能增强其健脾止泻作用。2.修治类：修治是除去杂质和非药用部分，以洁净药材，保证其符合医疗需要。如远志去心，山茱萸去核，乌梢蛇去头、鳞片等。3.产地类：中药讲究道地药材，医师在药名前常标明产地。如怀山药、田三七、东阿胶、杭白芍、广藿香、江枳壳、建泽泻等。4.品质类：药材的品质优劣直接影响到疗效，历代医家都非常重视药材的质量优劣，医师处方对药品质量提出了要求。如明天麻、子黄芩、左牡蛎、左秦艽、金毛狗脊、鹅枳实、马蹄决明、九孔石决明、净山楂等。5.采时、新陈类：药材的质量与采收季节密切相关，有的以新鲜者为佳，有的以陈久者为佳。医师处方对此也有不同要求。如绵茵陈（质嫩）、陈香橼、陈佛手、陈皮、嫩桂枝、鲜芦根、鲜茅根、霜桑叶等。6.颜色、气味类：药材的颜色和气味也与质量密切相关。如紫丹参、香白芷、苦杏仁（D错）等。焦山楂（C错）、煨木香（B错）应属于炮制类术语。